I期子宫内膜癌患者的治疗首选
A. 手术治疗
B. 化学治疗
C. 放射治疗
D. 内分泌治疗
E. 免疫治疗

正确答案：A。手术治疗

解析：Ⅰ期子宫内膜癌患者的治疗首选手术治疗（A对），行筋膜外全子宫切除术及双侧附件切除术。放射治疗（C错）仅用于有手术禁忌症或无法手术切除的晚期患者。化学治疗（B错）为晚期或复发子宫内膜癌综合治疗措施之一，也可用于术后有复发高危因素的患者的治疗。内分泌治疗（孕激素治疗）（D错）主要用于晚期或复发癌。免疫治疗（E错）多用于术后联合治疗，不单独应用。